患者，男，8岁。两天前意外致上中切牙碰伤，现有咬物痛。查：左上1牙冠完整，牙龈无红肿，叩（-）。电测活力良好，Ⅰ度松动，扪（-），X线片示根折线在根尖1/3处。处理应是
A. 调（牙合）、观察
B. 根管治疗
C. 患牙拔除
D. 牙髓摘除
E. 活髓切断

正确答案：A。调（牙合）、观察

解析：根尖1/3处根折的患牙，如牙髓状况良好，可调整咬合后观察。掌握“牙折”知识点。